治疗难辨梭状芽孢杆菌引起的假膜性肠炎，宜选择的药物是
A. 米诺环素
B. 万古霉素
C. 利奈唑胺
D. 阿奇霉素
E. 庆大霉素

正确答案：B。万古霉素

解析：本题考查万古霉素。治疗难辨梭状芽孢杆菌引起的假膜性肠炎，宜选择的药物是万古霉素（B对）。万古霉素不仅可以治疗难辨梭状芽孢杆菌引起的假膜性肠炎，还可用于治疗对甲氧西林耐药的葡萄球菌引起的感染，对青霉素过敏的患者及不能使用其他抗生素感染患者，如心内膜炎、骨髓炎、败血症或软组织感染等，用于防治血液透析患者发生的葡萄球菌属所致的动、静脉血分流感染等。米诺环素（A错）用于敏感菌引起的各类疾病，如败血症、梅毒、尿道炎、支气管炎等。利奈唑胺（C错）用于院内获得性肺炎、社区获得性肺炎、复杂性皮肤和皮肤软组织感染，包括未并发骨髓炎的糖尿病足部感染、非复杂性皮肤和皮肤软组织感染、万古霉素耐药的屎肠球菌感染。阿奇霉素（D错）用于治疗化脓性链球菌引起的急性咽炎、急性扁桃体炎；敏感细菌引起的鼻窦炎、中耳炎、急性支气管炎、慢性支气管炎急性发作；肺炎链球菌、流感嗜血杆菌以及肺炎支原体所致的肺炎等。庆大霉素（E错）用于敏感菌引起的痢疾、肠炎等肠道感染性疾病，也可用于腹部术前清洁肠腔。